阿胶除治阴虚燥咳外，又治
A. 骨蒸劳热
B. 血虚眩晕
C. 带下不止
D. 小便不禁
E. 咽痛，失音

正确答案：B。血虚眩晕

解析：本题考查的是阿胶的主治病证。阿胶除治阴虚燥咳外，又治血虚眩晕（B对）。阿胶：【主治病证】（1）血虚眩晕、心悸。（2）吐血，衄血，便血，崩漏，妊娠胎漏。（3）阴虚燥咳或虚劳喘咳。（4）阴虚心烦、失眠。浮小麦：【主治病证】（1）气虚自汗，阴虚盗汗。（2）骨蒸劳热（A错）。鹿衔草：【主治病证】（1）风湿痹痛，腰膝酸软。（2）崩漏经多，白带不止。（C错）（3）肺虚久咳，肺痨咳血。（4）劳伤吐血，外伤出血。芡实：【主治病证】（1）脾虚久泻不止。（2）肾虚遗精，小便不禁（D错），白带过多。诃子：【主治病证】（1）久泻，久痢，便血脱肛。（2）肺虚久咳，咽痛，失音（E错）。